关于部位记录法的说法错误的是
A. 以“+”符号将牙弓分为上、下、左、右四区
B. 每区以阿拉伯数字1～8分别代表中切牙至第三磨牙
C. 以罗马数字Ⅰ～Ⅴ分别依次代表每区的乳中切牙至第二乳磨牙
D. 牙位越远离中线，数字越小
E. 牙位越靠近中线，数字越小

正确答案：D。牙位越远离中线，数字越小

解析：部位记录法：以“+”将牙弓分为上下左右四区；每区以阿拉伯数字1～8分别依次代表中切牙至第三磨牙；以罗马数字Ⅰ～Ⅴ分别依次代表每区的乳中切牙至第二乳磨牙；牙位越靠近中线，数字越小；牙位越远离中线，数字越大。掌握“牙的组成、分类、功能及牙位记录”知识点。